患儿，9个月。发热，微汗，鼻塞流涕，咽红，夜间体温升高，又见惊惕啼叫，夜卧不安，舌质红，苔薄白，指纹浮紫。其诊断是
A. 夜啼
B. 感冒夹痰
C. 感冒夹惊
D. 急惊风
E. 小儿暑温

正确答案：C。感冒夹惊

解析：题中患儿发热，微汗，鼻塞流涕，咽红，为感受风热之邪所致，热扰心肝，出现惊惕啼叫，夜卧不安的症状。夜啼是因脾寒、心热、惊恐所致，以小儿白天能安静入睡，入夜则啼哭不安，时哭时止，或每夜定时啼哭，甚至通宵达旦为主要表现的病证，而非其他疾病引起的啼哭（A错）。感冒夹痰是在感冒的基础上兼有咳嗽较剧，痰多，喉间痰鸣等症状（B错）。感冒夹惊是在感冒的基础上兼有惊惕哭闹，睡卧不宁，甚至骤然抽风的症状（C对）。急惊风为痰、热、惊、风四证俱备，以四肢抽搐，颈项强直，角弓反张，神志昏迷为主要临床表现（D错）。小儿暑温是由暑温时邪引起的时行疾病，临床可见高热。头痛，呕吐，嗜睡或烦躁不安，甚则抽搐，昏迷等症状（E错）。